下列有关队列研究的说法正确的是
A. 当研究的危险因子暴露较普遍时，暴露组应从暴露率较高的人群中选择
B. 当研究的危险因素暴露较普遍时，暴露组应从一般人群中选择
C. 当研究的危险因子暴露并不普遍时，暴露组应从一般的人群中选择
D. 选择暴露组时，不必考虑暴露因素在人群中的分布情况
E. 以上都不是

正确答案：B。当研究的危险因素暴露较普遍时，暴露组应从一般人群中选择

解析：本题考查队列研究的暴露人群选择。在一般人群中选择暴露组，通常考虑两点：①不打算观察特殊人群发病的情况，而着眼于一般人群及今后在一般人群中的防治，使研究结果具有普遍意义；②所研究的因素和疾病都是一般人群中常见的（B对ACDE错），不必要选择特殊人群或没有特殊人群可寻。